紫外线对眼眼睛的主要损害为
A. 急性角膜结膜炎
B. 晶体混浊
C. 视网膜脉络膜灼伤
D. 视网膜剥离
E. 视神经乳头水肿

正确答案：A。急性角膜结膜炎

解析：本题考查紫外线对眼睛的损害。波长为250～320㎚的紫外线，可被角膜和结膜上皮大量吸收，引起急性角膜结膜炎（A对BCDE错），称为“电光性眼炎”，常见于电焊工及接触其他强紫外线辐射的作业者。电焊弧所产生的紫外线是导致眼紫外线损伤最多、最直接的原因。